阿霉素的特点包括
A. 骨髓抑制
B. 肾毒性
C. 心脏毒性
D. 抑制DNA及RNA的合成
E. 属细胞周期特异性药物

正确答案：A、C、D。骨髓抑制；心脏毒性；抑制DNA及RNA的合成

解析：本题考查阿霉素的特点。阿霉素又称多柔比星，为蒽环类抗肿瘤抗生素，属于细胞周期非特异性药物（E错），其毒性主要是骨髓抑制（A对）和心脏毒性（C对），心脏毒性可能是由于醌环被还原成半醌自由基，诱发了脂质过氧化反应，引起心肌损伤。心脏毒性为其剂量限制性毒性。多柔比星一般无肾毒性（B错）。多柔比星的作用机制为直接作用于DNA或嵌入DNA，干扰DNA的模板功能，从而干扰转录过程，阻止mRNA的形成（D对）。